钠水潴留容量依赖性高血压患者，治疗应首选的药物是
A. 噻嗪类利尿药
B. 血管紧张素Ⅱ受体拮抗剂
C. 糖皮质激素
D. 氨基糖苷类抗生素
E. 细胞毒药物

正确答案：A。噻嗪类利尿药

解析：钠水潴留容量依赖性高血压患者是指由钠摄入过多使水、钠潴留，血容量增多，心输出量增加，以致血压升高的患者，噻嗪类利尿剂可以排钾利尿，可作为首选治疗药物（A对）。